骨膜
A. 呈囊状包襄骨的表面
B. 包被骨的表面，但骨的关节面无骨膜
C. 由上皮组织构成
D. 与骨的再生无关
E. 无

正确答案：B。包被骨的表面，但骨的关节面无骨膜

解析：骨膜主要由纤维结缔组织构成（C错），包被骨的表面，但骨的关节面无骨膜（B对），含有丰富的神经、血管和淋巴管，对骨的营养、再生（D错）和感觉有重要作用。